听胎心发现胎心176次/分，此时恰当处置应是
A. 静脉滴注硫酸镁
B. 静脉快速滴注甘露醇
C. 对症处理
D. 立即行剖宫产术
E. 立即行催产素静脉滴注引产

正确答案：B。静脉快速滴注甘露醇

解析：26岁初孕妇，妊娠40周，出现头痛、眼花、呕吐（重度子痫前期可有持续头痛或视觉障碍或其它脑神经症状），血压180/110mmHg（重度子痫前期收缩压≥160mmHg和（或）舒张压≥110mmHg），应考虑妊娠期高血压疾病，按其分期为重度子痫前期。重度子痫前期患者妊娠＞37周应终止妊娠。听诊胎心发现胎心176次/分（正常胎心音110～160次/分），说明胎儿缺氧并不严重，此时恰当处置应是先静脉快速滴注甘露醇（B对）降低颅内压，再行剖宫产术。立即行剖宫产术（D错）易发生脑血管意外，并会大大增加手术风险。立即行催产素静脉滴注引产（E错）用时太长，该患者病情有可能短期内加重，对孕妇胎儿均不利。静脉滴注硫酸镁（A错）既可控制子痫的抽搐，也可预防子痫发作，但不能降低颅内压和血压。对症处理（C错）如止痛止吐对治疗重度子痫前期引起的剧烈头痛和呕吐无效，且会贻误病情。